若已知该省成年男性血红蛋白平均水平，欲了解某县正常成年男性的血红蛋白含量是否高于该省正常水平，应采用
A. 样本均数与总体均数比较的t检验
B. 配对t检验
C. 成组t检验
D. 配对设计差值的符号秩和检验
E. 成组设计两样本比较的秩和检验

正确答案：A。样本均数与总体均数比较的t检验